对三环类抗抑郁药中毒和解救的叙述，错误的是
A. 三环类抗抑郁药的中毒与血药浓度相关
B. 此类药物具有中枢和周围抗胆碱能作用
C. 中毒表现为兴奋状态、抑郁状态和心脏毒性
D. 心脏传导障碍和心律失常，是中毒常见的致死原因
E. 该类药物中毒的特异性解毒药物是氟马西尼

正确答案：E。该类药物中毒的特异性解毒药物是氟马西尼

解析：本题考查三环类抗抑郁药的中毒解救。对三环类抗抑郁药中毒和解救的叙述，错误的是该类药物中毒的特异性解毒药物是氟马西尼（E错，为本题正确答案）。发生心律失常时，可静脉滴注普鲁卡因胺0.5～1.0mg或利多卡因50～100mg 。如出现心力衰竭，可静脉注射毒毛花昔K0.25mg或毛花苷丙0.4mg。同时严格控制补液量和速度。发生低血压时，可扩充血量，必要时可使用去甲肾上腺素升压，但应尽量避免使用拟交感神经药物。癫病发作时可使用苯妥英钠治疗，避免使用苯二氮革类及巴比妥类药物，因为这两类药物有中枢神经系统和呼吸抑制作用。绝大多数三环类抗抑郁药的中毒反应严重程度与血药浓度相关（A对）。本类药物具有中枢和周围抗胆碱作用（B对），抑制心肌收缩，导致心排出量降低；并影响颈动脉窦与主动脉弓的化学和压力感受器，从而引起低血压，血压过低可引发周围循环衰竭。此外，心脏传导障碍和心律失常也是本类药物常见的致死原因（D对）。中毒特征：①抗胆碱作用症状；②心血管毒性；③癫痫发作（C对）。